手术治疗中一般病人知情权不包括
A. 有权自主选择
B. 有同意的合法权利
C. 有明确决定的理解力
D. 有家属代为决定的权利
E. 有做出决定的认知力

正确答案：D。有家属代为决定的权利

解析：本题考查医患关系伦理。手术治疗中一般病人知情权不包括有家属代为决定的权利（D错，为本题正确答案）。知情同意权包括知情权和同意权两个方面，单纯的知情或单纯的同意都不能称之为知情同意。知情权是指患者有权了解和认识自己所患疾病，包括检查、诊断、治疗、处理及预后等方面的情况，并有权要求医师作出通俗易懂的解释；有权知道所有为其提供医疗服务的医务人员的身份、专业特长、医疗水平等；有权检查医疗费用，并有权要求医方逐项作出详细的解释；有权查阅医疗记录，知悉病历中的信息，并有权复印病历等。同意权是指患者及其家属有权接受或拒绝某项治疗方案及措施。